“瘦肉精”中毒的解救方法有
A. 催吐
B. 洗胃
C. 导泻
D. 给予美托洛尔
E. 给予克伦特罗

正确答案：A、B、C、D。催吐；洗胃；导泻；给予美托洛尔

解析：本题考查瘦肉精中毒解救。瘦肉精中毒后一般建议及时进行催吐（A对）、洗胃（B对）、导泄（C对），使用β受体拮抗剂美托洛尔（D对）解救。克伦特罗（E错）为瘦肉精的药品通用名，瘦肉精中毒给予克伦特罗会加重中毒。